男婴，8个月。腹泻伴呕吐3天，无尿6小时。大便10～15次/天，呈蛋花汤样伴黏液，有腥臭味。查体：T37.8℃，表情淡漠，前囟、眼窝明显凹陷，皮肤弹性差，可见花纹，四肢厥冷，双肺呼吸音清，心率120次/分，腹软，无明显压痛。实验室检查：粪镜检偶见白细胞，血钠134mmol/L。患儿脱水的程度和性质是
A. 重度等渗水性脱水
B. 中度等渗水性脱水
C. 重度低渗水性脱水
D. 中度低渗水性脱水
E. 重度高渗水性脱水

正确答案：A。重度等渗水性脱水

解析：患儿腹泻伴呕吐，大便10～15次/天，呈蛋花汤样伴黏液，有腥臭味（产毒性大肠埃希菌肠炎的临床表现）。无尿6小时，表情淡漠，前囟、眼窝明显凹陷，皮肤弹性差，可见花纹，四肢厥冷（重度脱水表现），血钠134mmol/L（正常值130～150mmol/L，为等渗性脱水）。根据患者的病史、临床表现和实验室检查，最可能的诊断是产毒性大肠埃希菌肠炎。中度脱水的患儿前囟、眼窝轻度凹陷，皮肤弹性轻度降低，无花纹，哭时泪少，尿少，足稍凉（BD错）。低渗性脱水时血清钠低于130mmol/L；等渗性脱水时血清钠在130～150mmol/L；高渗性脱水时血清钠大于150mmol/L（CE错）。因此该患儿脱水的程度和性质是重度等渗水性脱水（A对）。